下列叙述中，不正确的描述是
A. 高位残根可用根钳直接拔除
B. 折断部位低于牙槽嵴断根，去除少许牙槽骨壁后，可用根钳拔除
C. 根钳无法夹住的低位残根应使用牙挺
D. 牙根断面是斜面，根挺应从斜面较高的一侧插入
E. 使用根挺时不应以腭侧骨板做支点

正确答案：E。使用根挺时不应以腭侧骨板做支点

解析：本题掌握牙根拔除术。使用根挺时可以用腭侧骨板做支点（E错，为本题正确答案）。